男，42岁。进油腻饮食后腹胀、腹痛4小时。持续性上腹痛，伴有恶心、呕吐、发热、腰背部不适。查体：T38.4C，P124次/分，BP90/60mmHg，急性痛苦貌，巩膜无黄染，腹饱满，全腹肌紧张，有压痛和反跳痛，上腹为主，肠鸣音消失。右下腹穿刺抽出淡红色血性液体。血WBC16.2×10⁹/L，N0.9。血清淀粉酶6000U/L（Somogyi法）。引起这种疾病常见因素不包括
A. 腹部外伤
B. 暴饮暴食
C. 酗酒
D. 胆道感染
E. 胃食管反流

正确答案：E。胃食管反流

解析：急性胰腺炎的致病危险因素包括腹部外伤（A对）、暴饮暴食（B对）、酗酒（C对）、胆道感染（D对）、十二指肠液反流、胰腺血液循环障碍等。胃食管反流多引起导致反流性食管炎，不会导致急性胰腺炎（E错，为本题正确答案）。